休克早期机体的代偿功能主要表现为：
A. 神志清醒
B. 尿量有所恢复
C. 肛温由下降开始回升
D. 血压维持在正常水平
E. 以上都不对

正确答案：D。血压维持在正常水平

解析：休克早期机体的代偿功能主要表现血压维持在正常水平（D对ABCE错）和维持心脑血液供应。